当筛检的疾病漏诊后果较严重时，要求筛检试验具有较高的
A. 特异度
B. 灵敏度
C. 约登指数
D. 阴性似然比
E. 阳性预测值

正确答案：B。灵敏度

解析：本题考查提高筛检收益的方法。当筛检的疾病漏诊后果较严重时，要求筛检试验具有较高的灵敏度（B对ACDE错），尽可能多的发现病人，尽量避免漏诊给患者带来不必要的麻烦。